以下疾病需用X线检查诊断，但不包括
A. 急性根尖周炎
B. 邻面龋和继发龋
C. 牙内、外吸收
D. 慢性根尖周炎
E. 髓石和弥漫钙变

正确答案：A。急性根尖周炎

解析：本题考查需用X线检查诊断的疾病。以下疾病需用X线检查诊断，但不包括急性根尖周炎（A错，为本题的正确答案）。急性根尖周炎X线检查无明显异常表现。龋病（B对）X线片显示透射影。牙内吸收（C对）X线片表现为髓腔内膨大透射影，牙外吸（C对）收X线片表现为牙根外残缺。慢性根尖周炎（D对）分为根尖周肉芽肿、慢性根尖周脓肿、根尖周囊肿、根尖周致密性骨炎。根尖部透射影圆形，范围小，边界清楚，周围骨质正常或稍显致密，多考虑根尖周肉芽肿；根尖区透射影边界不清楚，形状不规则，周围骨质较疏松呈云雾状，多为慢性根尖周脓肿；若有较大的圆形透射影区，边界清楚，并有一圈阻射白线围绕多考虑根尖周囊肿；根尖部骨质呈局限性的致密阻射影像，无透射区多考虑根尖周致密骨炎。髓石和弥散性钙化（E对）X线片显示髓腔处的透射区消失。